为防止或抑制微生物生长繁殖，防止物体腐烂的方法，但细菌不一定被杀灭，此种方法是
A. 消毒
B. 灭菌
C. 防腐
D. 无菌
E. 抑菌

正确答案：C。防腐

解析：防腐为防止或抑制微生物生长繁殖，防止物体腐烂的方法，细菌不一定被杀灭。用于防腐的化学制剂，称为防腐剂。许多化学消毒剂，在低浓度时可作为防腐剂使用。掌握“消毒与灭菌”知识点。